缺血性脑梗塞和出血性脑梗塞最有鉴别意义的是
A. 头疼
B. 意识障碍
C. 脑电图
D. 安静时突发
E. 颅脑CT

正确答案：E。颅脑CT

解析：颅脑CT平扫是脑卒中患者首选的影像学检查方法（E对）；头疼（A错）、意识障碍（B错）是出血性脑梗塞的症状，安静时突发为（D错）缺血性脑梗死的症状，脑电图（C错）不用于脑血管疾病的检查。